白斑的诊断
A. 可根据临床检查做出
B. 可根据血液化验获得
C. 可根据家族病史确认
D. 必须有病理检查证实
E. 必须由间接免疫荧光检查做出

正确答案：D。必须有病理检查证实

解析：白斑的诊断须根据临床表现和组织病理学检查方可确诊。组织病理检查结果可为单纯性增生和异常增生。掌握“口腔白斑病”知识点。